男，54岁。发作性胸痛3天，于劳累时发作，休息5分钟可缓解，每天发作3～4次，最近2小时内上述症状发作2次，每次持续20分钟。该患者最恰当的处理措施是
A. 门诊预约超声心动图检查
B. 立即收住院行心电图运动负荷试验
C. 立即收住院监测心电图和血肌钙蛋白
D. 门诊预约动态心电图检查
E. 立即收住院行胸部X线片检查

正确答案：C。立即收住院监测心电图和血肌钙蛋白

解析：患者中年男性，3天前出现发作性胸痛，于劳累时发作，休息5分钟可缓解，提示为稳定型心绞痛，最近胸痛发作频率增加，持续时间延长（2小时内上述症状发作2次，每次持续20分钟），提示心绞痛有恶化倾向，考虑发展为不稳定型心绞痛。患者随时有突发心肌梗死的危险，此时最恰当的处理措施是立即收住院监测心电图和血肌钙蛋白。监测心电图可观察发作时ST-T动态改变，同时监测血肌钙蛋白有助于了解是否有无心肌损伤（C对）。不稳定型心绞痛的心脏超声、胸部X线等检查结果和稳定型心绞痛的结果相似（P230）。多数稳定型心绞痛患者超声心动图检查无异常，超声心动图可用于心绞痛的鉴别诊断如梗阻性肥厚型心肌病等（A错）。胸部X线片（P223）对稳定型心绞痛的诊断并无特异的诊断意义，仅有助于了解其他心肺疾病的情况，如有无心脏增大、充血性心力衰竭等，帮助鉴别诊断（E错）。心电图运动负荷试验的禁忌症包括心肌梗死急性期、不稳定型心绞痛、明显心力衰竭、严重心律失常或急性疾病者（P220）。本例患者考虑为不稳定型心绞痛，故禁作运动试验（B错）。动态心电图（P159）可提高一过性心律失常的检出率，对诊断各种心律失常、晕厥原因、了解起搏器工作情况等有重要意义，并不适用于本例患者（D错）。